黏合力强、可用来增加片剂的硬度，但吸湿性较强的辅料是
A. 硫酸钙
B. 微晶纤维素
C. 淀粉
D. 糖粉
E. 药用碳酸钙

正确答案：D。糖粉

解析：本题考查片剂的常用辅料。糖粉（D对）系指结晶性蔗糖经低温干燥粉碎后而成的白色粉末。本品黏合力强，可增强片剂硬度，但吸湿性较强，长期贮存会使片剂的硬度过大，延缓崩解或溶出。无机钙盐类（如硫酸钙（A错）、磷酸氢钙及碳酸钙（E错）等）、微晶纤维素（B错）、淀粉（C错）常用作片剂的稀释剂。